儿茶不具有的功效是
A. 活血止痛
B. 收湿敛疮
C. 生肌止血
D. 明目退翳
E. 清肺化痰

正确答案：D。明目退翳

解析：本题考查的是儿茶的功效。儿茶不具有的功效是明目退翳（D错，为本题正确答案）。儿茶：【功效】收湿敛疮（B对），生肌止血（C对），活血止痛（A对），清肺化痰（E对）。明目退翳为蝉蜕的功效，蝉蜕：【功效】疏散风热，透疹止痒，明目退翳，息风止痉。